药品批发企业的下列岗位人员中，应当接受相关法律法规和专业知识培训并经考核合格后方可上岗的有
A. 从事现有均需冷藏的药品类体外诊断试剂储存管理工作的人员
B. 从事需阴凉储存的生物制品运输管理工作的人员
C. 从事中药材、中药饮片养护管理工作的人员
D. 从事第二类精神药品储存管理工作的人员

正确答案：A、D。从事现有均需冷藏的药品类体外诊断试剂储存管理工作的人员；从事第二类精神药品储存管理工作的人员

解析：本题考查的是药品经营人员的资质。药品批发企业的下列岗位人员中，应当接受相关法律法规和专业知识培训并经考核合格后方可上岗的有从事现有均需冷藏的药品类体外诊断试剂储存管理工作的人员（A对）与从事第二类精神药品储存管理工作的人员（D对）。从事特殊管理的药品和冷藏冷冻药品的储存、运输等工作的人员，应当接受相关法律法规和专业知识培训，且必须经考核合格后方可上岗参与相关工作。